脏腑经络功能减退，血液生成不足，运行滞缓，水液在体内潴留等病变，与气机功能失常密切相关的是
A. 温煦作用
B. 推动作用
C. 防御作用
D. 固摄作用
E. 气化作用

正确答案：B。推动作用

解析：本题考查的是气的生理功能。脏腑经络功能减退，血液生成不足，运行滞缓，水液在体内潴留等病变，与气机功能失常密切相关的是推动作用（B对）。气的生理功能包括：1.推动作用：气是活动能力极强的精微物质，对人体生长发育、各脏腑组织器官的功能活动、血液的循行、津液的生成输布和排泄等，均能发挥激发和推动作用。如果气的推动作用减弱，则影响生长发育，甚至出现早衰；使脏腑组织器官、经络等功能减退；或使血液、津液的生成不足，运行滞缓，而发生血虚、血行不利或水液在体内潴留等病变。2.温煦作用（A错）：气的运动是人体热量的来源。人体体温的恒定，依赖气的温煦和调节；各脏腑组织器官、经络等，也要在气的温煦作用下，才能进行正常的生理活动；“血得温则行，得寒则凝”，血和津液之所以能保持液态在体内不停地运行，除依赖于气的推动外，也要依靠气的温煦作用，方可不致凝聚。例如，体内气虚，温煦作用失常，便会引起畏寒喜热、四肢不温、体温下降、血行滞缓、津液凝聚等病变。反之，因某些原因引起局部或全身气盛有余，则还会表现为局部或全身发热等病变。3.防御作用（C错）：气具有防御和抵抗各种邪气的功能，主要表现在：一是护卫肌表，防止外邪侵入；二是与侵入体内的各种邪气进行斗争。气的防御功能，是通过脏腑经络的生理功能而体现的。脏腑经络功能正常，说明正气充沛，防御和战胜邪气的力量就强，则不易受邪而患病。故《素问·刺法论》云：“正气存内，邪不可干”。反之，若正气不足，防御和战胜邪气的力量减弱，外邪得以侵入机体，则容易受邪而发生各种病变。4.固摄作用（D错）：气的固摄作用，主要是对于精、血、津液等物质具有防止其无故流失，以及维护脏腑器官各自位置的相对恒定等作用。具体表现在：固摄血液，即维持血液在脉管内循行，防止逸出脉外；固摄汗液、尿液、唾液、胃液、肠液等正常物质分泌和排泄，防止其无故外泄和流失，从而维持体内水液代谢的相对平衡；维持脏腑器官位置的稳定，使之保持正常的生理活动和脏腑之间功能的相互协调，维持胎儿在胞宫内的安定和正常发育等。5.气化作用（E错）：气化，是指通过气的运动而产生的各种变化。气化作用的过程，实际上就是体内物质代谢的过程，即物质转化和能量转化的过程。具体地说，即是指精、气、血、津液等物质的新陈代谢及相互转化。例如，将饮食物转化成水谷之精气，然后再化生为气、血、津液、精等；津液经过代谢，可转化成汗液、尿液、涕、唾、泪、涎等；饮食物经过消化和吸收后，其残渣可转化成糟粕排出体外等，都是气化作用的具体表现。气的五种功能，虽然各不相同，但都是人体生命活动中不可缺少的，它们相互协调配合，相互为用，维持着生理活动的正常进行。